下列哪种联系是病因研究所寻找的
A. 统计学联系
B. 虚假联系
C. 间接联系
D. 直接联系
E. 因果联系

正确答案：E。因果联系